急性缺血性脑卒中（心源性）起病24-48小时的治疗应选用
A. 低分子右旋糖酐
B. 阿司匹林
C. 低分子肝素
D. 重组人纤维酶原激活剂（r-PA）
E. 巴曲酶

正确答案：B。阿司匹林

解析：依据最新版本神经病学教材：心源性脑栓塞急性期一般不推荐抗凝治疗，急性期的抗凝不比抗血小板更有效，但显著增加了脑出血和全身出血的风险。对大部分房颤导致的卒中患者，可在发病4-14天开始口服抗凝治疗，预防卒中复发。但本题题干该患者急性缺血性脑卒中（心源性）起病24小时后（C错）。低分子右旋糖酐（A错）用于血流动力型TIA的扩容治疗。阿司匹林（B对）用于反复短暂性脑缺血发作和非心源性脑卒中的治疗。重组人纤维酶原激活剂（r-PA）（D错）用于卒中患者的溶栓治疗（发病时间少于6小时）。巴曲酶（E错）用于脑卒中的降纤治疗，疗效尚不明确，不作为一线药物。